不孕患者，检测排卵功能，对诊断关系不大的辅助检查方法为
A. B超检测卵巢排卵
B. 月经周期后半期宫颈黏液检查
C. 肾上腺功能检测
D. 基础体温测定
E. 月经周期后半期子宫内膜活检

正确答案：E。月经周期后半期子宫内膜活检

解析：B超（A对）能检测子宫大小和形态、子宫内膜的厚度和分型及卵巢的基础状态，监测卵泡发育。月经周期后半期宫颈黏液检查（P23）（B对）可根据结晶的多少及羊齿状的完整与否了解卵巢功能，排卵期的宫颈黏液稀薄而量多，若将黏液作涂片检查，干燥后可见羊齿植物叶状结晶。基础体温测定（P346）（D对）不仅有助于判断有无排卵，还可提示黄体功能不足、子宫内膜脱落不全。肾上腺功能可以检测不孕患者的排卵功能（C对）。月经周期后半期子宫内膜活检（E错，为本题正确答案）对于检测不孕患者的排卵功能，诊断意义不大。